玉竹的原植物属于
A. 百合科
B. 天南星科
C. 兰科
D. 姜科
E. 百部科

正确答案：A。百合科

解析：本题考查的是玉竹的来源。玉竹的原植物属于百合科（A对）。玉竹：【来源】为百合科植物玉竹的干燥根茎。来源于天南星科（B错）的中药有天南星、半夏、石菖蒲等。来源于兰科（C错）的中药有天麻、白及、石斛、铁皮石斛等。来源于姜科（D错）的中药有莪术、姜黄、郁金、砂仁、草果、豆蔻、草豆蔻、益智等。来源于百部科（E错）的中药有百部等。